在乳汁中分泌量较高，主要用于治疗厌氧菌感染的药品是
A. 左氧氟沙星
B. 氯霉素
C. 磷霉素
D. 万古霉素
E. 甲硝唑

正确答案：E。甲硝唑

解析：本题考查哺乳期妇女用药。在乳汁中分泌量较高，主要用于治疗厌氧菌感染的药品是甲硝唑（E对）。哺乳期患者接受抗菌药物后，药物可自乳汁分泌，少数药物乳汁中分泌量较高，如氟喹诺酮类、四环素类、大环内酯类、氯霉素、磺胺甲噁唑、甲氧苄啶、甲硝唑等。若疑有厌氧菌属感染，可采用对厌氧菌有效的抗菌药，如甲硝唑、链霉素、琥乙红霉素、氯霉素、多西环素。左氧氟沙星（A错）属于喹诺酮类药物，对乳儿骨关节有潜在危害，不宜应用。氯霉素（B错）在乳汁中的浓度为血清中的一半，有明显骨髓抑制作用，可引起灰婴综合征，故哺乳期禁用。磷霉素（C错）对革兰阳性菌、革兰阴性菌及多种抗生素耐药的葡萄球菌均有抗菌作用。万古霉素（D错）为糖肽类抗菌药物，对革兰阳性菌有强大的抗菌活性。可导致听力减退，甚至耳聋。妊娠期妇女应避免使用。哺乳期妇女试用期间应暂停哺乳。仅在有明确指征时方可使用并应进行治疗药物监测。